男性，50岁，左耳垂后下肿胀、破溃后有脓液流出，其中可见针尖大小淡黑色颗粒，经化验为硫黄颗粒。对于该病最有效的药物是
A. 大环内酯类
B. 青霉素族
C. 喹诺酮类
D. 氨基糖苷类
E. 硝基咪唑类抗生素

正确答案：B。青霉素族

解析：本题考查颌面部软组织放线菌病的治疗药物。患者左耳垂后下肿胀、破溃后有脓液流出，其中可见硫黄颗粒，综合考虑为颌面部放线菌病。对于该病最有效的药物是青霉素族（B对）。颌面部放线菌病的药物治疗：①抗菌药物：首选大剂量青霉素治疗，如与磺胺联合应用，可能提高疗效。红霉素、林可霉素、 四环素氯霉素和克林霉素亦可选用；②碘制剂：一般常用 5%-10%碘化钾口服；③免疫疗法：用放线菌溶素作皮内注射。大环内酯类（A错）、喹诺酮类（C错）、氨基糖苷类（D错）、硝基咪唑类抗生素（E错）一般不用于颌面部放线菌病的治疗。